维生素D缺乏性手足搐搦症发生惊厥是由于
A. 血钾浓度降低
B. 血钠浓度降低
C. 血钙浓度降低
D. 血磷浓度降低
E. 血镁浓度降低

正确答案：C。血钙浓度降低

解析：维生素D缺乏血钙下降而甲状旁腺不能代偿性分泌增加时，血钙继续降低，低于1.75-1.8mmol/L或离子钙低于1.0mmol/L时可引起神经肌肉兴奋性增高，表现为抽搐（C对）。